尿路感染诊断的最重要依据是
A. 有尿频、尿急、尿痛症状
B. 腰痛和肾区叩痛
C. 有真性细菌尿
D. 有白细胞尿
E. 有蛋白管型

正确答案：C。有真性细菌尿

解析：典型的尿路感染有尿路刺激症（尿频、尿急、尿痛）、感染中毒症状、腰部不适等。凡是有真性细菌尿者（C对），均可诊断为尿路感染。无症状性细菌尿诊断主要依据细菌学检查，要求两次细菌培养均为同一菌种的真性菌尿。尿频尿急尿痛症状（A错）虽可见于尿路感染，但还可见于肿瘤或神经精神因素刺激所致，对尿路感染诊断价值不大。腰痛和肾区叩痛（B错）、蛋白管型（E错）可见于多种肾脏疾病，对泌尿系感染诊断价值不大。白细胞尿（D错）可见于尿路感染，还可见于肾小球肾炎，可作为尿路感染的辅助诊断依据。